心理健康的首要标准是
A. 智力正常
B. 情绪良好
C. 人际和谐
D. 社会适应
E. 人格完整

正确答案：A。智力正常

解析：智力正常是人正常生活的最基本的心理条件，是心理健康的首要标准。掌握“心理健康概述”知识点。